两侧前庭襞间的裂隙
A. 喉前庭
B. 喉中间腔
C. 声门下腔
D. 声门裂
E. 前庭裂

正确答案：E。前庭裂

解析：两侧前庭襞之间的裂隙称前庭裂（E对）。